患者，男，50岁。右下颌膨隆3个月、下唇麻木2周入院。1年前，患者由于右下后牙松动、疼痛，于当地医院拔除患牙，疼痛缓解；3个月前出现右下颌膨隆，2周前出现右下唇麻木。入院查体：一般情况良好。专科检查：右下颌角及下颌体部稍膨隆，表面皮肤色泽正常。开口度、开口型未见明显异常。口内黏膜未见明显改变，未见溃疡、瘘管、糜烂及新生物。右下第一、二磨牙缺失，右下第一、二前磨牙Ⅰ度松动，咬合关系正常。舌运动良好，无疼痛及麻木感，口底、颊黏膜正常，右下唇麻木。双侧腮腺导管口无红肿，分泌物清亮。双侧面颈部未触及肿大淋巴结。曲面体层片示右下颌自下颌角至右下尖牙可见一大小约7.0cm×2.0cm不规则溶骨性破坏区，边界虫蚀状，波及牙槽骨，自髓质向皮质扩展，密度不均。该病例的诊断可除外以下哪种疾病
A. 中央性颌骨癌
B. 牙龈癌
C. 浆细胞肉瘤
D. 纤维肉瘤
E. 骨肉瘤

正确答案：B。牙龈癌

解析：本题考查中央性颌骨癌及上颌窦癌。根据临床表现：口内黏膜未见明显变化，右下颌角及下颌骨体部稍膨隆，可排除牙龈癌（B错，为本题正确答案）的可能。